关于气雾剂制备的叙述，错误的是
A. 制备工艺主要包括:容器、阀门系统的处理与装配，药物的配制与分装及抛射剂的填充
B. 制备混悬型气雾剂应将药物微粉化，并分散在水中制成稳定的混悬液
C. 抛射剂的填充方法有压灌法和冷灌法
D. 压灌法设备简单，并可在常温下操作
E. 冷灌法抛射剂损失较多，故应用较少

正确答案：B。制备混悬型气雾剂应将药物微粉化，并分散在水中制成稳定的混悬液